属于内酯型前药，需要在体内代谢为羧酸形式才具有活性的药物是
A. 氟伐他汀
B. 普伐他汀
C. 阿托伐他汀
D. 瑞舒伐他汀
E. 洛伐他汀

正确答案：E。洛伐他汀

解析：本题考查调血脂药物的药理活性。洛伐他汀（E对）属于内酯型前药，亲脂性较强，口服吸收率较低，须在肝脏中水解成为开环羟基酸型方有药理活性。开环羟基酸型他汀药：水溶性较强（普伐他汀（B错））或兼具脂溶性和水溶性（氟伐他汀（A错）、阿托伐他汀（C错）、瑞舒伐他汀（D错）和匹伐他汀），具有较高的吸收率，一般不受食物影响。